一氧化碳中毒时，最容易损坏的器官或组织是
A. 眼睛
B. 外周神经
C. 肝脏
D. 肾脏
E. 脑

正确答案：E。脑